下列关于口服缓控释制剂的处方设计错误的是
A. 剂量调整的灵活性低
B. 药物的剂量溶解度和油水分配系数都会影响口服缓控剂的设计
C. 半衰期小于1小时的药物一般不宜制成口服缓控释制剂
D. 口服缓控释制剂应与相应的普通制剂生物等效
E. 稳态时血药浓度的峰谷浓度比口服缓控释制剂应大于普通制剂

正确答案：E。稳态时血药浓度的峰谷浓度比口服缓控释制剂应大于普通制剂

解析：本题考查口服缓控释制剂的处方设计。缓控释制剂稳态时峰谷浓度应小于普通制剂（E错，为本题正确答案）；缓控释制剂应用时对剂量调节的灵活性降低（A对）；剂量、溶解度、油水分配系数是影响口服缓控释制剂设计的理化因素（B对）；半衰期小于1h或大于12h的药物一般不适宜制成缓控释制剂（C对）；口服缓控释制剂应与相应的普通制剂生物等效（D对）。